患者因上前牙有白色斑要求治疗。检查：左右上1唇面有白垩斑，探光滑，硬。余（-）。该患牙诊断为
A. 浅龋
B. 釉质发育不全症
C. 氟牙症
D. 四环素牙
E. 以上各种疾病均有可能

正确答案：B。釉质发育不全症

解析：本题考查牙釉质发育不全。患者因上前牙有白色斑要求治疗。检查：左右上1唇面有白垩斑，探光滑，硬。余（-）。该患牙诊断为釉质发育不全症（B对）。根据病例描述，左右上1唇面有白垩斑，探光滑，硬，余（-），可知只有左右上1这一组牙发生了白垩色斑，且白垩色斑光滑，较硬，则考虑左右上1为釉质发育不全症。浅龋主要表现为龋损部位色泽变黑，呈白垩色改变，用探针检查时有粗糙感（A错）。氟牙症也有白垩色斑，但氟牙症发生在同一时期萌出的牙上，牙数较多（C错）。四环素牙初呈黄色，以后逐渐由黄色变成棕褐色或深灰色，并无白垩色改变（DE错）。